20岁某青年摘除扁桃体后，发热出现心力衰竭。采血培养细菌，血平板有草绿色溶血环的小菌落形成。涂片染色为G+链状排列球菌，诊断为甲型溶血性链球菌引起的心内膜炎。试问下列菌中还有哪种菌能形成草绿色溶血环菌落
A. 金黄色葡萄球菌
B. 表皮葡萄球菌
C. 乙型溶血链球菌
D. 丙型链球菌
E. 肺炎链球菌

正确答案：E。肺炎链球菌

解析：甲型溶血性链球菌（在血琼脂平皿上，菌落周围有1～2mm宽的草绿色溶血环，称α溶血）肺炎链球菌在血琼脂平皿上形成α-溶血环。掌握“链球菌属”知识点。